公共场所是
A. 公众从事各种社会活动的临时性生活环境
B. 公众从事各种社会活动的固定生活环境
C. 公众进行娱乐、交流、购物等活动的封闭式生活环境
D. 公众进行娱乐、交流、购物等活动的开放式生活环境
E. 固定人群从事各种社会活动的临时性生活环境

正确答案：A。公众从事各种社会活动的临时性生活环境

解析：本题考查公共场所。公共场所是公众从事各种社会活动的临时性生活环境（A对BCDE错），它是根据公众生活活动和社会活动的需要，人工建成的具有多种服务功能的公共建筑设施，供公众进行学习、工作、休息、文体、娱乐、参观、旅游、交流、交际、购物、美容等活动之用。